上半身前倾坐位听诊更明显的是
A. 二尖瓣狭窄舒张中晚期隆隆样杂音
B. 二尖瓣关闭不全收缩期吹风样杂音
C. 主动脉狭窄收缩期吹风样杂音
D. 主动脉瓣关闭不全舒张期叹气样杂音
E. 胸骨左缘第2肋间机器声样连续性杂音

正确答案：D。主动脉瓣关闭不全舒张期叹气样杂音

解析：上半身前倾坐位听诊更明显的是主动脉瓣关闭不全舒张期叹气样杂音（D对）。二尖瓣狭窄舒张中晚期隆隆样杂音于左侧卧位听诊更明显（A错）。二尖瓣关闭不全收缩期吹风样杂音于心尖区听诊最明显（B错）。主动脉狭窄收缩期吹风样杂音于胸骨右缘1～2肋间听诊最明显（C错）。胸骨左缘第2肋间机器声样连续性杂音见于动脉导管未闭（E错）。